影响聚酰胺对黄酮类化合物吸附作用的主要因素有
A. 化合物中羟基的数目
B. 化合物中羟基的位置
C. 溶剂与化合物之间形成氢键缔合能力的大小
D. 溶剂与聚酰胺之间形成氢键缔合能力的大小
E. 分子本身的大小

正确答案：A、B、C、D。化合物中羟基的数目；化合物中羟基的位置；溶剂与化合物之间形成氢键缔合能力的大小；溶剂与聚酰胺之间形成氢键缔合能力的大小